室间隔的描述哪名是错误的？
A. 在卵圆窝处房间隔最薄
B. 卵圆窝是房间隔缺损的好发部位
C. 室间隔分肌部和膜部
D. 膜部缺乏心内膜
E. 膜部是室间隔缺损的常见部位

正确答案：D。膜部缺乏心内膜

解析：在卵圆窝处房间隔最薄（A对）。卵圆窝是房间隔缺损的好发部位（B对）。室间隔可分为肌部和膜部两部分（C对）。室间隔膜部有心内膜（D错，为本题正确答案）。膜部是室间隔缺损的常见部位（E对）。